药品零售企业的行为规则包括
A. 拒绝调配有配伍禁忌或超剂量的处方
B. 调配处方必须经过核对
C. 有真实完整的药品检验记录
D. 销售药品准确无误并正确说明用法、用量和注意事项
E. 从合法药品生产、经营企业购药

正确答案：A、B、D、E。拒绝调配有配伍禁忌或超剂量的处方；调配处方必须经过核对；销售药品准确无误并正确说明用法、用量和注意事项；从合法药品生产、经营企业购药